不属于消化性溃疡的临床表现是
A. 上腹疼痛
B. 饥饿样不适感
C. 出血、穿孔
D. 腹泻
E. 剑突下持续疼痛

正确答案：D。腹泻

解析：本题考查消化性溃疡的临床表现。消化性溃疡主要指发生在胃和十二指肠的溃疡，而腹泻（D错，为本题正确答案）的病变多在直肠或乙状结肠。消化性溃疡的临床表现主要有：上腹疼痛（A对）、饥饿样不适感（B对）、出血、穿孔（C对），剑突下持续疼痛（E对）。